原发性不孕，中医学称为
A. 断续
B. 胞阻
C. 无子
D. 半产
E. 暗产

正确答案：C。无子

解析：原发性不孕中医学又称为“无子”、“绝子”等（C对）。继发性不孕称为“断续”（A错）。胞阻又名妊娠腹痛（B错）。半产即小产，为至三、五月而胎堕（D错）。暗产指怀孕未足一月而流产者（E错）。